治寒积便秘，常与大黄配伍的药有
A. 芦荟
B. 秦皮
C. 巴豆
D. 芒硝
E. 干姜

正确答案：C、E。巴豆；干姜

解析：本题考查大黄的配伍。治寒积便秘，常与大黄配伍的药有巴豆（C对）、干姜（E对）。大黄【配伍】大黄配巴豆、干姜：大黄苦寒，功善泻热通便、攻积导滞；巴豆辛热，功善峻下冷积；干姜辛热，功善温中散寒。三药相配，巴豆得大黄，其泻下之力变缓和而持久；大黄得巴豆，其寒性可去；再加温中散寒之干姜，以助散寒之力，故善治寒积便秘。大黄配芒硝（D错）：大黄苦寒，功能泻下攻积、清热泻火、解毒；芒硝咸寒，功能泻下、软坚、清热。两药相配，既善泻下攻积，又善润软燥屎，还善清热泻火，治实热积滞、大便燥结、坚硬难下效佳。芦荟（A错）【功效】泻下，清肝，杀虫。秦皮（B错）【功效】清热解毒，燥湿止带，清肝明目。